双子叶植物根类药材横切面上通常可见的一圈环纹是
A. 木栓形成层
B. 皮层纤维束环带
C. 内皮层
D. 形成层
E. 环髓纤维

正确答案：D。形成层

解析：本题考查的是根的横断面或横切面特征。双子叶植物根类药材横切面上通常可见的一圈环纹是形成层（D对）。观察根的横断面或横切面特征，首先应注意区分双子叶植物的根和单子叶植物的根：一般双子叶植物的根有自中心向外的放射状结构，木部尤为明显；形成层环大多明显，环内的木部较环外的皮部大；中心常无髓；外表常有栓皮。单子叶植物的根横断面自中心向外无放射状结构；内皮层（C错）环较明显；中央有髓；外表无木栓层，有的具较薄的栓化组织。其次，应注意根的断面组织中有无分泌组织散布，如伞形科植物当归、白芷均有黄棕色油点。还应注意少数双子叶植物根的异常构造，如何首乌皮部异形维管束形成的“云锦状花纹”，商陆的异形维管束形成数个突起的同心环，习称“罗盘纹”等。观察根茎的横断面，首先应注意区分双子叶植物根茎和单子叶植物根茎。一般来说，双子叶植物根茎外表常有木栓层（A错）；横切面有放射状结构，木部尤为明显；中央有明显的髓部；形成层环明显。单子叶植物根茎外表无木栓层或仅具较薄的栓化组织；横切面不呈放射状结构，皮层及中柱均有维管束（B错）小点散布；无髓部；通常可见内皮层环纹。其次，应注意根茎断面组织中有无分泌组织散布，如伞形科的川芎、白芷、羌活等，菊科的白术、苍术、木香等均有油点等。还应注意少数双子叶植物根茎的异常构造，如大黄的“星点”等。环髓纤维（E错），2022年考试指南未明确说明。